患者胃脘胁肋胀满疼痛，走窜不定，呃逆嗳气，吞酸嘈杂，呃逆，不思饮食，情绪抑郁，善太息舌淡红，苔薄黄，脉弦，其临床意义是
A. 肝郁脾虚证
B. 肝胃不和证
C. 肝胆湿热证
D. 肝郁气滞证
E. 胃热炽盛证

正确答案：B。肝胃不和证

解析：患者肝气郁结，肝失疏泄，横逆犯胃，胃气郁滞，故胃脘胁肋胀满疼痛，走窜不定；胃气上逆，胃失和降，则呃逆嗳气；肝胃气滞，郁而化火，故吞酸嘈杂；胃受纳失职，故不思饮食；肝失疏泄，故情绪抑郁，善太息；脉弦，为肝气郁滞所致；舌苔薄黄，为气郁化火之证；故辨证为肝胃不和证（B对）。肝郁脾虚证的临床表现是胸胁胀满窜痛，腹胀纳呆，腹痛欲泻，泻后痛减，或便溏不爽，肠鸣矢气，兼见善太息，情志抑郁，或急躁易怒，舌苔白，脉弦或缓（A错）。肝胆湿热证的临床表现是胁肋胀痛，纳呆腹胀，泛恶欲呕，口苦厌油，身目发黄，大便不调，小便短黄；或寒热往来，舌红，苔黄腻，脉弦滑数；或阴部潮湿、瘙痒、湿疹，阴器肿痛，带下黄臭等（C错）。肝郁气滞证的临床表现是胸胁、少腹胀满疼痛，走窜不定，情志抑郁，善太息，妇女可见乳房胀痛，月经不调、痛经、闭经，苔薄白，脉弦（D错）。胃热炽盛证的临床表现是胃脘灼痛、拒按，消谷善饥，口气臭秽，齿龈红肿疼痛，甚则化脓、溃烂，或见齿衄，渴喜冷饮，大便秘结，小便短黄，舌红苔黄，脉滑数（E错）。